可以静脉给药的剂型有
A. 水溶液型注射剂
B. 油溶液型注射剂
C. O/W型乳剂型注射剂
D. 油混悬液型注射剂
E. 水混悬液型注射剂

正确答案：A、C。水溶液型注射剂；O/W型乳剂型注射剂

解析：本题考查静脉注射给药的剂型。水溶液型注射剂（A对）、O/W型乳剂型注射剂（C对）可以静脉注射给药。输液是指由静脉滴注输入体内的大剂量注射液，常用的有电解质溶液、营养输液、胶体输液和含药输液。水溶液型注射剂是可以静脉给药的剂型。脂肪乳加入乳化剂与注射用水而制成水包油型乳化剂，可以静脉注射，提供高能肠外营养。肌内注射可以是溶液剂、混悬剂或乳剂，所用溶剂有水、复合溶剂或油等，容量一般为2～5ml，而静脉注射不可（BDE错）。